人参的主产地是
A. 甘肃
B. 河南
C. 四川
D. 云南
E. 吉林

正确答案：E。吉林

解析：本题考查的是人参的产地。人参的主产地是吉林（E对）。人参：【产地】主产于吉林、辽宁、黑龙江等省，多为栽培品。主产地甘肃（A错）的药材有当归、秦艽等。主产于河南（B错）的药材有著名的四大怀药“地黄、牛膝、山药、菊花”等。主产于四川（C错）的药材有川贝母、川芎、黄连、川乌等。主产于云南（D错）的药材有三七、木香、重楼、茯苓、萝芙木、诃子、草果、马钱子、儿茶等。